胆管癌的主要临床表现是
A. 厌食、恶心、呕吐
B. 腹痛、黄疸
C. 腹痛、黄疸和寒战高热
D. 无痛性黄疸
E. 体重明显减轻

正确答案：D。无痛性黄疸

解析：胆管癌的主要症状是黄疸，随着癌肿的增大，胆道梗阻加重，所以黄疸呈进行性加重。所以，胆管癌的典型表现为无痛进行性加重性黄疸（D对）。厌食、恶心、呕吐（A错）为非特异性胃肠道症状，不是胆管癌的主要临床表现。胆管癌若未合并感染，不会出现腹痛（B错）。腹痛、黄疸和寒战高热（C错）是Charcot三联征，见于胆管炎。体重明显减轻（E错）可见于各种晚期肿瘤，无特异性。